男性，28岁，因车祸颌面部外伤8小时后急诊。检查：患者左面部肿胀明显，眶周眼睑及结膜下淤斑、压痛，张口受限，张口度半指，咬合关系正常。有效的治疗措施是
A. 局部冷敷
B. 抗生素及激素治疗
C. 颌间牵引及固定
D. 颅颌绷带固定
E. 手术切开复位内固定

正确答案：E。手术切开复位内固定

解析：颧骨、颧弓骨折后，如仅有轻度移位，畸形不明显，无张口受限、复视及神经受压等功能障碍者，可作保守治疗。凡有塌陷畸形、张口受限、复视者均为手术适应证。虽无功能障碍但有明显畸形者也可考虑手术复位内固定。掌握“颧骨及颧弓、眼眶骨折及骨折愈合过程”知识点。